面神经从茎乳孔到开始分支的这一段为面神经主干，面神经主干的长度为
A. 1.0cm～1.5cm
B. 1.5cm～2cm
C. 2cm～2.5cm
D. 2.5cm～3cm
E. 3cm～3.5cm

正确答案：B。1.5cm～2cm

解析：面神经从茎乳孔到开始分支的这一段，称为面神经主干，长1.5～2cm。此段在茎乳孔附近发出分支分布于耳后肌、二腹肌和茎突舌骨肌。掌握“面神经、舌咽神经、舌下神经的分支与分布”知识点。